—健康儿童，体检结果，身高是115cm，体重20kg。该儿童的年龄可能是
A. 6岁
B. 7岁
C. 8岁
D. 9岁
E. 10岁

正确答案：A。6岁

解析：2～12岁小儿身高估计公式为：身高（cm）等=年龄（岁）×7+75，因此本例年龄=（身高-75）÷7=（115-75）÷7≈6（岁）。1～12岁小儿体重的估计公式为：体重（kg）=年龄（岁）×2+8，因此本例年龄=（体重-8）÷2=（20-8）÷2=6（岁）。因此，该儿童的年龄可能是6岁（A对）。